患者，女，60岁。急性化脓性乳腺炎切开排脓，用红升丹药条引流2天，周围出现大片皮疹，瘙痒，疮口脓腐未尽。外治应首选
A. 七三丹
B. 五五丹
C. 八二丹
D. 黑虎丹
E. 白降丹

正确答案：D。黑虎丹

解析：患者疮口脓腐末尽应应用提脓祛腐药，提脓去腐的主药是升丹，目前常用的有九一丹、八二丹、七三丹、五五丹、九黄丹等，但患者用红升丹药条引流2天，周围出现大片皮珍，瘙痒，提示升丹过敏，因此不能继续用含升丹的药，尚有不含升丹的提脓祛腐药，如黑虎丹，用于升丹的过敏者（D对ABCC错）。白降丹功能主治为：治痈疽发背，一切疔毒（E错）